男，35岁。腰痛伴右侧下肢放射性疼痛3个月，无明显发热、盗汗。查体：右下肢直腿抬高试验阳性，小腿前外侧和足内侧感觉感觉减退，拇背伸肌力减退。最可能的病变部位是
A. L₂₋₃
B. L₃₋₄
C. L₁₋₂
D. L₄₋₅
E. L₅～S₁

正确答案：D。L₄₋₅

解析：患者青年男性，腰痛伴右侧下肢放射性疼痛（腰椎间盘突出症典型表现），右侧直腿抬高试验阳性（腰椎间盘突出重要体征），小腿前外侧和足底感觉减退、背伸肌力减退，结合患者病史、体查及临床表现，该患者最可能的诊断为腰椎间盘突出症。腰椎间盘突出部位不同，受累神经不同，病人常出现相应的感觉、肌力及反射异常。该患者有小腿前外侧和足底感觉减退，背伸肌力减退，根据P755 腰神经根病变的神经定位图表，可知该患者受累神经为表现L5，故最可能的病变部位是L4-5（D对）。L2-3病变（A错）对应L3受累，表现为股骨内髁感觉减退，股四头肌肌力减弱，膝反射减弱或消失。L3-4（B错）病变对应L4受累，表现为内踝感觉减退，足背伸肌肌力减弱。L1-2（C错）病变对应L2受累，表现为大腿前中部感觉减退，髂腰肌肌力减弱。L5-S1（E错）病变对应S1受累，外踝附近及足外侧痛、触觉感觉减退，足跖屈障碍，踝反射减弱或消失。